谵妄综合征的主要特征为
A. 意识障碍、昼轻夜重
B. 幻觉
C. 注意涣散
D. 记忆减退
E. 错觉

正确答案：A。意识障碍、昼轻夜重

解析：谵妄的临床特征包括：1.意识障碍：为主要特征，有明显的昼夜节律变化，表现为昼轻夜重（A对）；2.感知障碍：错觉和幻觉，以视错觉和视幻觉较常见；3.注意障碍：注意涣散，表现为注意力不集中；4.定向障碍：对周围环境与事物的觉察清晰度降低。幻觉、注意力涣散和错觉均属于谵妄的临床特征，但均非主要特征（BCE错）。记忆力减退为痴呆的主要特征（D错）。